铸造金属全冠牙体预备提供的（牙合）面间隙一般为
A. 1mm
B. 1.5mm
C. 2.0mm
D. 2.5mm
E. 3mm

正确答案：A。1mm

解析：本题考查铸造金属全冠。铸造金属全冠的牙体预备：（牙合）面预备的目的是为铸造金属全冠提供（牙合）面间隙，一般为1.0mm（A对），并为修复体建立正常（牙合）关系提供条件。最新版课本：一般为0.8～1.5mm，相较之下A为最优选项。为防止牙体预备过多或不足，必要时用软蜡或咬合纸检查；注意在正中（牙合），前伸（牙合）及侧方（牙合）时均应有足够间隙。（牙合）面形态与应力有关，陡坡会增加牙冠的侧向力，而影响冠的固位与稳定，应予以降低。如（牙合）面因缺损已有间隙，应按照铸造全冠（牙合）面厚度检查间隙大小，不足者再做适当预备。